月经期使用清洁卫生巾
A. 减少经血量
B. 舒适
C. 不需清洗
D. 避免感染
E. 避免痛经

正确答案：D。避免感染

解析：本题考查女性经期的保健要点。经血是多种病毒、细菌、衣原体、支原体的培养基，女性应使用清洁卫生巾，以保证外阴清洁、避免感染（D对ABCE错）。